肺炎链球菌性肺炎的治疗首选
A. 头孢曲松
B. 青霉素
C. 万古霉素
D. 氨苄西林
E. 替考拉宁

正确答案：B。青霉素

解析：青霉素（B对）属于β-内酰胺类抗生素，是治疗敏感的G⁺球菌和杆菌、G⁻球菌及螺旋体所致感染的首选药，如溶血性链球菌引起的蜂窝织炎、肺炎链球菌引起的大叶性肺炎等。头孢曲松（A错）（P373）为第三代头孢菌素，主要对G⁻菌包括肠杆菌类、铜绿假单胞菌及厌氧菌有较强的作用。万古霉素（C错）仅用于严重G⁺菌感染，特别是MRSA、MRSE和肠球菌属所致的感染，如败血症、心内膜炎、骨髓炎、呼吸道感染等。氨苄西林（D错）对革兰阳性菌的作用与青霉素G近似，对绿色链球菌和肠球菌的作用较优，对其他菌的作用则较差。替考拉宁（E错）可用于治疗各种严重的革兰阳性菌感染，包括不能用青霉素类和头孢菌素类其他抗生素者，但不作为首选药物。